碘量法测定维C含量用的指示剂是
A. 冰醋酸
B. 酚酞
C. 甲基橙
D. 淀粉
E. 结晶紫

正确答案：D。淀粉

解析：本题考查碘量法。碘量法测定维C含量用的指示剂是淀粉（D对）。冰醋酸（A错）是非水碱量法的溶剂。酚酞（B错）和甲基橙（C错）是酸碱滴定法的指示剂。结晶紫（E错）是非水碱量法的指示剂。